CCU患者在发病初期全部表现不同程度的焦虑状态，哪项不是产生焦虑的原因
A. 24小时昼夜不分的医护工作
B. 各种导管造成的压迫感
C. 活动受限，被迫长期处于一定体位
D. 心理烦躁不安
E. 同室患者的抢救、死亡等

正确答案：D。心理烦躁不安